关于面侧深区，错误的是
A. 位于腮腺咬肌区
B. 前为上颌骨的后面
C. 后界为腮腺深面
D. 内为翼外板
E. 外以下颌支为界

正确答案：A。位于腮腺咬肌区

解析：本题考查面侧深区位置与境界。关于面侧深区，错误的是位于腮腺咬肌区（A错，为本题的正确答案）。面侧深区的境界 前为上颌骨后面（B对），后界腮腺深叶（C对）（深叶及腮腺组织的深面），内为翼外板（D对），外以下颌支为界（E对）。面侧深区的内容包括翼丛、上颌动脉、下颌神经与翼外肌。